对预防地方性碘缺乏病没有作用的措施是
A. 饮水加碘
B. 食盐加碘
C. 多吃海产品
D. 服用促甲状腺激素
E. 服用碘剂

正确答案：D。服用促甲状腺激素

解析：本题考查地方性碘缺乏病的预防措施。碘缺乏病是指从胚胎发育至成人期由于碘摄入量不足而引起的一系列病症。其预防措施有：饮水加碘（A对）；食盐加碘（B对）；服用碘剂（E对）；多吃海产品（C对）等。促甲状腺激素是腺垂体分泌的促进甲状腺的生长和机能的激素，具有促进甲状腺滤泡上皮细胞增生、甲状腺激素合成和释放的作用。服用促甲状腺激素（D错，为本题正确答案）没有预防地方性碘缺乏病的作用。